青霉素G钾在磷酸盐缓冲液中降解的变化属于
A. 水解
B. 氧化
C. 异构化
D. 聚合
E. 脱羧

正确答案：A。水解

解析：本题考查药物降解途径。青霉素G钾在磷酸盐缓冲液中降解的变化属于水解（A对）。青霉素G钾属于酰胺类药物，酰胺类药物分子中存在着不稳定的β-内酰胺环，在 H⁺或 OH­⁻影响下，易裂环失效，水解成酸与胺。青霉素G钾在磷酸盐缓冲液中降解就是不稳定的β-内酰胺环的水解开环反应。氧化（B错）是氧元素与其他物质元素发生的变化。异构化（C错）是改变化合物的结构而不改变其组成和分子量的过程。聚合（D错）是两个或多个分子结合在一起形成复杂分子的过程。脱羧（E错）是在特殊情况下，羧酸脱去羧基的反应。